就全国农村而言，饮用水安全的问题主要来自
A. 放射性污染
B. 化学性污染
C. 生物地球化学性
D. 生物性污染
E. 生物性和放射性污染

正确答案：D。生物性污染

解析：本题考查农村饮用水的卫生状况。就全国范围而言，广大农民的饮用水是不够安全的，其危害主要来自地球化学性和环境化学性污染的威胁。就全国范围而言，农村饮水的突出问题仍是生物性污染危害（D对ABCE错）。